患儿，女，3岁，面色少华，不思饮食，形体偏瘦，舌淡苔薄白。其治法是
A. 健脾化湿
B. 健脾和胃
C. 疏肝和胃
D. 消食导滞
E. 和脾助运

正确答案：E。和脾助运

解析：患儿以不思饮食为主症，故诊断为厌食。胃主受纳，脾主运化，脾胃虚弱，纳谷不香，脾虚失运，则不思饮食；后天生化乏源，则见面色少华，形体偏瘦；舌淡苔薄白为脾胃气虚之象，故其证候为脾胃气虚证，治以健脾益气，佐以助运（E对）。健脾化湿（A错）适用于脾虚水湿不化证。健脾和胃（B错）适用于脾胃虚弱、脾胃不和之证。疏肝和胃（C错）适用于肝胃不和证。消食导滞（D错）适用于食积证。